药品经营企业违反药品管理法规定，在购销药品中无真实、完整的购销记录且情节严重的，应吊销其
A. 《药品生产许可证》
B. 《药品经营许可证》
C. 《医疗机构制剂许可证》
D. 《医疗机构执业许可证》
E. 《进口药品注册证》

正确答案：B。《药品经营许可证》

解析：本题考查违反药品经营管理要求的法律责任。药品经营企业违反药品管理法规定，在购销药品中无真实、完整的购销记录且情节严重的，应吊销其《药品经营许可证》（B对）。经营企业购销药品未按照规定记录，零售企业未依法开展药学服务的法律责任：根据《药品管理法》第一百三十条规定，药品经营企业购销药品未按照规定进行记录，零售药品未正确说明用法、用量等事项，或者未按照规定调配处方的，责令改正，给予警告；情节严重的，吊销药品经营许可证。